某农药厂包装工，因敌敌畏瓶破碎浸湿上衣。工作中出现头晕、流涕、咳嗽而急诊，按感冒对症治疗。一周后症状加重，伴恶心、多汗，再次就诊。检查中医师闻到衣服上有大蒜气味，曾怀疑农药中毒，但继续对症处理，未入院。次日，患者头晕、视物模糊频繁呕吐、步态不稳，继而躁动不安，全身肌束颤动。入院后用阿托品、解磷定治疗，但不久因呼吸、心跳停止，复苏无效死亡。促使患者死亡最重要的原因是
A. 患者的中毒表现不典型
B. 解毒药物使用不当
C. 对症治疗掩盖了病情
D. 延误诊断和治疗
E. 诊断和治疗手段落后

正确答案：D。延误诊断和治疗